恶性淋巴瘤累及颈腹股沟淋巴结、肝及肺并伴有发热，盗汗及体重减轻，临床分期属
A. ⅢA
B. ⅣB
C. ⅣA
D. ⅢB
E. ⅡB

正确答案：B。ⅣB

解析：恶性淋巴瘤患者累及颈、腹股沟淋巴结、肝及肺（肝或骨髓受累，即使局限也属Ⅳ期），提示为Ⅳ期；患者同时伴有发热、盗汗及体重减轻等全身症状（1.不明原因发热大于38℃；2.盗汗；3.半年内体重下降10%以上，出现一项即可分为B组），提示为B组，故患者临床分期为ⅣB期（B对）。